一患者阑尾切除术后5天体温一直在38.5℃～39.2℃，并出现腹泻10次/日，伴里急后重，可能发生
A. 切口裂开
B. 手术后出血
C. 盆腔脓肿
D. 尿路感染
E. 切口感染

正确答案：C。盆腔脓肿

解析：患者阑尾切除术后5天出现高热，出现并发症腹膜炎时可出现腹泻，所以患者可能发生盆腔脓肿（C对）。腹会阴联合直肠癌根治术（Miles手术）原则上适用于腹膜返折以下的直肠癌。切口裂开多发生于术后1周，咳嗽时腹压增加，感觉切口疼痛和骤然松开，随即伴有淡红色液体自切口溢出或（和）脏器脱出（A错）。如术后出现下列情况应高度警惕内出血：①有引流者，当引流出的血液每小时超过100mL，持续数小时则提示有内出血存在。②腹胀或呼吸困难进行性加重，以及在手术部位严重肿胀的同时，出现不明原因的急性贫血者，要考虑有内出血。③术后早期出现失血性休克的临床表现，每小时尿量少于25mL；特别是经容量治疗后仍有休克或少尿的征象，或一度好转后又再度恶化者（B错）。尿路感染一般都会表现为尿频、尿急、尿痛等症状（D错）。切口感染的临床表现为伤口局部红、肿、热、疼痛和触痛，有分泌物（浅表伤口感染），伴有或不伴有发热和白细胞增加（E错）。